男，32岁。发热、头痛伴呕吐2天，意识障碍半天，于8月20日来诊。查体：T39.6℃，P130次/分，R23次/分，BP125/70mmHg，浅昏迷，皮肤未见瘀点，颈抵抗（+），Kernig征（+），Babinski征（+）。实验室检查：血WBC16.0×10⁹/L，N0.73，L0.27。最可能的诊断是
A. 结核性脑膜炎
B. 流行性乙型脑炎
C. 新型隐球菌脑膜炎
D. 病毒性脑炎
E. 流行性脑脊髓膜炎

正确答案：B。流行性乙型脑炎

解析：患者中年男性，发热、头痛伴呕吐2天，意识障碍半天，查体：浅昏迷，皮肤未见瘀点，颈抵抗（+），Kernig征（+），Babinski征（+）。实验室检查：血WBC16.0×10⁹/L，N0.73，L0.27。可初步诊断为普通型流行性乙型脑炎（B对）。结核性脑膜炎多为慢性病程，主要表现为结核中毒症状、脑膜刺激症状和颅内压增高、脑实质损害等（A错）。新型隐球菌脑膜炎的发病常有慢性消耗性疾病或全身免疫缺陷性疾病的病史，慢性隐匿病程，临床表现为脑膜炎的症状和体征，脑脊液墨汁染色检出隐球菌可确诊（C错）。病毒性脑炎原发感染前驱期可有发热、全身不适、头痛、肌痛、嗜睡、腹泻等症状，白细胞增高以淋巴细胞为主（D错）。流行性脑脊髓膜炎前驱期表现为上呼吸道感染症状，如低热、鼻塞、咽痛等，随之出现败血症的全身中毒表现，皮肤黏膜出现瘀点瘀斑，再后出现出现脑膜刺激症状和颅内压增高症状（E错）。